男，40岁。发现血尿、蛋白尿5年。查体：BP150/90mmHg，24小时尿蛋白定量1.0～1.7g，血肌酐100μmol/L。理想的血压控制目标是
A. 小于160/95mmHg
B. 小于140/90mmHg
C. 小于140/85mmHg
D. 小于135/85mmHg
E. 小于125/75mmHg

正确答案：E。小于125/75mmHg

解析：患者初步诊断为慢性肾炎，慢性肾炎控制血压时，尿蛋白≥1g/d，血压应控制在125/75mmHg以下；尿蛋白＜1g/d，血压控制可放宽到130/80mmHg以下，患者尿蛋白大于1g/d，因此应控制到125/75mmHg以下（E对）。目前高血压控制一般主张的目标值为140/90mmHg，但是糖尿病、慢性肾脏病、心力衰竭或病情稳定的冠心病合并高血压患者血压控制目标值＜130/80mmHg（P252-P253）（ABCD错）。请注意，八版内科学上慢性肾炎血压控制标准为130/80mmHg以下，与蛋白尿程度无关。